男，9岁。尿少浮肿1天。体检：眼睑部浮肿，血压140/100mmHg，尿蛋白（+），尿红细胞（+++）。该患儿诊断是
A. 急性肾小球肾炎
B. 泌尿系感染
C. 单纯性肾病
D. 肾炎性肾病
E. 继发性肾病

正确答案：A。急性肾小球肾炎

解析：男孩，有血尿、蛋白尿（+）、水肿、血压增高，应诊断为急性肾小球肾炎（A对）。泌尿系感染的尿检会有大量的白细胞，不符合泌尿系感染的特征（B错）。肾病综合征的尿蛋白定性多在+++，而此患儿的的尿蛋白仅有（+），不能诊断为肾病综合征（CD错）。继发性肾病一定会有原发病，而该患儿的所有临床表现都是急性肾小球肾炎，没有任何其他疾病的表现，因此该患儿是原发性肾病不是继发性肾病（E错）。